风寒感冒适用的法则是
A. 正治法
B. 从治法
C. 反治法
D. 补虚法
E. 反佐法

正确答案：A。正治法

解析：正治是指采用与证候性质相反的方药进行治疗的治则，风寒感冒以辛温解表为治疗原则，故属于正治法（A对）。反治，指顺从病证的外在假象而治的治则。由于采用的方药性质与病证中假象的性质相同，故又称为“从治”（BC错）。补虚法指用扶持助长机体正气的治则，使正气充足以消除病邪，恢复健康，适用于各种虚证（D错）。反佐法指于温热方药中加少量寒凉药，或寒证则药以冷服法；寒凉方药中加少量温热药，或治热证则药以热服法。此法属反治法之范畴（E错）。